下列哪项与正气强弱密切相关
A. 居住地域环境
B. 工作环境
C. 精神状态
D. 气候变化
E. 以上均非

正确答案：C。精神状态

解析：体质和精神状态是决定正气强弱的主要因素（C对）。而工作环境（B错）、气候变化（D错）和居住地域条件（A错）等则影响正邪两个方面。